急性重型肝炎临床表现描述有误的是
A. 黄疸加深
B. 肾功能障碍
C. 有出血倾向
D. 少量腹水
E. 两周后出现肝性脑病

正确答案：E。两周后出现肝性脑病

解析：急性重型肝炎临床表现：既往无同型肝炎病史，起病甚急，可有发热、食欲缺乏、恶心、频繁呕吐、极度乏力等明显的消化道及全身中毒症状；黄疸逐渐加深；肝脏进行性缩小；有出血倾向、中毒性鼓肠、肝臭、少量腹水、急性肾衰竭（肝肾综合征）；起病14日以内出现不同程度的肝性脑病（Ⅱ～Ⅴ度）表现；凝血酶原活动度低于40%。掌握“病毒性肝炎”知识点。